异丙肾上腺素是
A. α受体激动药
B. β受体激动药
C. α、β受体激动药
D. M受体激动药
E. N受体激动药

正确答案：B。β受体激动药

解析：本题考查药物的手性特征及其对药物作用的影响。异丙肾上腺素（B对）是非选择性的β受体激动药，能作用于β₁和β₂受体。兴奋β₁ 肾上腺素受体，增快心率、增强心肌收缩力，增加心脏传导系统的传导速度，缩短窦房结的不应期；作用于支气管β₂肾上腺素受体，使支气管平滑肌松弛。